牙齿黄染及牙釉质发育不全
A. 氯霉素
B. 米诺环素
C. 阿奇霉素
D. 左氧氟沙星
E. 庆大霉素

正确答案：B。米诺环素

解析：本题考查药物的不良反应。牙齿黄染及牙釉质发育不全的是米诺环素（B对）。米诺环素属四环素类，可与钙盐形成络合物，伴随钙盐沉积于牙齿及骨骼中，致使儿童牙齿黄染，影响骨质发育。新生儿因葡糖醛酸结合酶不足，应用氯霉素（A错）可能出现厌食、呕吐、腹胀，进而发展为循环衰竭，全身呈灰色，称为“灰婴综合征”。阿奇霉素（C错）一般耐受性良好，不良反应发生率较低，多为轻到中度可逆性反应。左氧氟沙星（D错）属于喹诺酮类药物，可引起关节痛、关节肿胀及软骨损害，影响骨骼发育。庆大霉素（E错）属氨基糖苷类抗生素，可引起第Ⅷ对脑神经损伤。